可导致神经毒性，四肢麻木，腱反射消失的抗肿瘤药是
A. 柔红霉素
B. 长春新碱
C. 紫杉醇
D. 博来霉素
E. 环磷酰胺

正确答案：B。长春新碱

解析：本题考查长春新碱的不良反应。长春新碱（B对）的神经系统毒性为此类药物的剂量限制性毒性反应，主要表现为四肢麻木，腱反射消失，腹痛和便秘、甚至麻痹性肠梗阻等。柔红霉素（A错）为蒽环类抗肿瘤药，有心脏毒性。紫杉醇（C错）易发生超敏反应。博来霉素（D错）最严重的毒性就是肺毒性，可出现间质性肺炎和肺纤维化，对骨髓抑制和胃肠道反应均较轻。环磷酰胺（E错）属于破坏DNA的烷化剂，有膀胱毒性。